善治热结痰盛之咽喉肿痛的是
A. 马勃
B. 射干
C. 牛蒡子
D. 山豆根
E. 板蓝根

正确答案：B。射干

解析：本题考查的是射干的性能特点。善治热结痰盛之咽喉肿痛的是射干（B对）。射干：【性能特点】本品苦泄散，寒清解，有小毒，力较强，入肺、肝经。既清热降火而消肿解毒，又散瘀祛痰而消结除癥。善治热结痰瘀之咽喉肿痛、痰饮咳喘（喉中辘辘如水鸡声）、久疟疟母、闭经、痈肿、瘰疬、癥瘕等。马勃（A错）：【性能特点】本品辛能透散，质轻上浮，平而偏凉，专入肺经，药力平和。既清热解毒，又疏散风热，善消肿、利咽，凡咽喉肿痛、咳嗽失音无论肺热还是风热所致者均宜。兼止血，凡出血无论内热还是外伤所致者皆宜。牛蒡子（C错）：【性能特点】本品辛散苦泄，寒清滑利，入肺、胃经。既清散风热而解表、透疹，又宣肺祛痰而利咽、止咳；还滑利二便，导热（疹）毒排出而清解消疮疹。发汗不如薄荷，长于清解热毒与滑利二便，凡风热、热毒、肺热、痰热所致病证皆宜，兼二便不利者尤佳。山豆根（D错）：【性能特点】本品寒清苦泄而降，有毒力强，入肺、胃、心经。善清泻心肺胃火而解毒、消肿、利咽，药力颇强，治咽喉肿痛属火毒炽盛者最宜，治胃火牙龈肿痛亦佳。实火壅塞者多用；风热者不宜早用，完全化热时方可用。板蓝根（E错）：【性能特点】本品苦泄寒清，入心、肝、胃经，药力强。善清心肝胃热毒，长于凉血利咽，为治温病斑疹吐衄及热毒咽痛、丹毒、痄腮之要药，尤善治咽喉肿痛与颜面丹毒（大头瘟疫）。